我国轻工系统规定表面活性剂7天生物降解率必须大于多少
A. 0.5
B. 0.6
C. 0.7
D. 0.8
E. 0.9

正确答案：D。0.8

解析：本题考查我国轻工系统规定的表面活性剂7天生物降解率。我国轻工系统规定，所用表面活性剂7天生物降解率必须大于80%（D对ABCE错）。